急进性肾小球肾炎的病理类型
A. 微小病变型肾病
B. 新月体性肾小球肾炎
C. 硬化性肾小球肾炎
D. 系膜增生性肾小球肾炎
E. 毛细血管内增生性肾小球肾炎

正确答案：B。新月体性肾小球肾炎

解析：急进性肾小球肾炎的肾小球壁层上皮细胞增生，形成新月体，故病理类型是新月体性肾小球肾炎（B对）。微小病变肾病（A错）、硬化性肾小球肾炎（C错）和系膜增生性肾小球肾炎（D错）为肾病综合征（P268）的病理类型。毛细血管内增生性肾小球肾炎（E错）是急性肾炎（P265）的病理类型。